说明乙肝病毒有复制的指标是
A. HBsAg（﹢）、HBeAg（﹣）、抗HBc（﹢）
B. HBsAg（﹣）、抗HBs（﹢）、抗HBc（﹢）
C. HBsAg（﹢）、HBeAg（﹢）、HBV﹣DNA（﹢）
D. HBsAg（﹢）、HBeAg（﹣）、HBV﹣DNA（﹣）
E. HBsAg（﹢）、HBeAg（﹣）、HBV﹣DNA（﹢）

正确答案：C。HBsAg（﹢）、HBeAg（﹢）、HBV﹣DNA（﹢）